不直接注入大隐静脉
A. 腹壁下静脉
B. 股外侧浅静脉
C. 股内侧浅静脉
D. 阴部外静脉
E. 腹壁浅静脉

正确答案：A。腹壁下静脉

解析：腹壁下静脉（A错，为本题正确答案）直接注入髂外静脉。股外侧浅静脉（B对）、股内侧浅静脉（C对）、阴部外静脉（D对）、腹壁浅静脉（E对）均为大隐静脉的属支，直接注入大隐静脉。